某医生进行一项研究，他随机抽取100例经病理确诊为大肠癌的患者和100例正常人，检测这两组人群的血清胆固醇，发现病例中有62人低于正常值，而正常人中只有18人低于正常值，因此他认为低胆固醇是大肠癌发生的一个主要危险因素，此结论
A. 正确
B. 不正确，因为没有进行统计学显著性检验
C. 不正确，因为没有排除可能的信息偏倚
D. 不正确，因为样本量小
E. 不正确，因为不能确定何是因何是果

正确答案：E。不正确，因为不能确定何是因何是果